适合做固定义齿的基牙
A. 根尖周病变未治疗的牙齿
B. 牙冠畸形轻度扭转
C. 吸收达根尖1/2
D. 松动度2°
E. 倾斜超过35°

正确答案：B。牙冠畸形轻度扭转

解析：本题考查固定义齿基牙的选择。适合做固定义齿的基牙为牙冠畸形轻度扭转者（B对）。对于倾斜移位的牙，如果患者年轻，在有条件时，最好先经正畸治疗改正牙位后，再选作桥基牙；或者选择适当的固位体设计，使牙体预备时既能取得共同就位道，又不至于损伤牙髓，并在另一端增加桥基牙以分散给力。根尖周病变未治疗的牙齿（A错）、吸收达根尖1/2（C错）、松动度2°（D错）、倾斜超过35°（E错）均可影响固定义齿的修复，故此类牙齿不宜作为固定义齿修复的基牙。